应对和解决突发食品安全事件需要的监测是
A. 常规监测
B. 专项监测
C. 应急监测
D. 主动监测
E. 被动监测

正确答案：C。应急监测

解析：本题考查应急监测。应急监测（C对ABDE错）是为应对和解决突发食品安全事件或某些特殊安全形势的需要，要求快速有效地掌握问题的原因和现状等，针对性更强。